女性，48岁。发作性剑突下及右上腹绞痛3天，伴有寒战，半年前有过类似发作史。查体：体温39℃，脉搏110次/分，血压140/85mmHg。血常规检查：WBC12×10⁹/L，N80%，神志清楚，皮肤巩膜轻度黄染，右肋缘下扪及肿大的胆囊，轻度触痛。首选的检查方法是
A. 腹部B超
B. MRCP
C. ERCP
D. PTC
E. 腹部CT

正确答案：A。腹部B超

解析：患者中年女性，右上腹绞痛、体温39℃（中等度热，正常值36～37℃）、皮肤、巩膜轻度黄染（黄疸）（Charcot三联征，胆管炎典型表现），胆囊肿大多为肝外胆管结石阻塞胆总管下段，引起胆汁分泌受阻，胆总管压力增高，胆汁经胆囊颈管逆流充盈胆囊。患者最可能的诊断是肝外胆管结石并胆管炎。腹部B超（A对）可以发现结石，并明确其大小和部位，操作简单，价格低廉，对结石的诊断准确率接近100%，是首选的检查方法。MRCP（磁共振胰胆管造影）（B错）、腹部CT（E错）可显示结石，但其价格较高；ERCP（C错）、PTC（D错）也可显示结石，但属于有创检查，易引起并发症，以上检查均不宜作为首选检查。